血虚生风可见
A. 眩晕欲仆，肢麻震颤
B. 目睛上吊，四肢抽搐
C. 手足蠕动，目陷睛迷
D. 肢体麻木，手足拘挛不伸
E. 皮肤干燥，瘙痒

正确答案：D。肢体麻木，手足拘挛不伸

解析：血虚生风是指血液虚少，筋脉失养而动风的病机变化，临床可见肢体麻木不仁，筋肉跳动，甚则手足拘挛不伸等症（D对）。肝阳化风指肝阳偏亢，或肝肾阴亏，阴不致阳致肝阳亢逆无制而动风的病机变化，临床轻者可见眩晕欲扑，筋惕肉瞤，肢麻震颤，或见口眼歪斜、半身不遂，重致卒然昏倒，神志昏迷（A错）。热极生风指热邪炽盛，燔灼津液，劫伤肝阴，筋脉失养而动风，表现为在高热不退基础上出现痉厥，抽搐，鼻翼扇动，目睛上吊，神昏谵语等症（B错）。阴虚风动指阴气衰竭，宁静、抑制功能减退而动风，多见于热病后期，临床可见筋挛肉瞤，手足蠕动等症（C错）。血燥生风指血虚津亏，失润化燥，肌肤失于濡养而生风，临床多见皮肤干燥或肌肤甲错，伴有皮肤瘙痒或落屑等症（E错）。